对自身基因转录具有调控作用的DNA序列是
A. 顺式作用元件
B. 反式作用元件
C. 顺式作用因子
D. 反式作用因子
E. 顺/反式作用元件

正确答案：A。顺式作用元件